卡维地洛治疗心力衰竭的药理作用包括
A. 上调β受体
B. 抑制RAS和血管升压素
C. 改善心肌舒张功能
D. 抗心律失常
E. 抗生长和抗自由基

正确答案：A、B、C、D、E。上调β受体；抑制RAS和血管升压素；改善心肌舒张功能；抗心律失常；抗生长和抗自由基